女，48岁。进大量肉食后上腹痛伴呕吐6小时。腹痛为持续性，阵发加重，向左腰背部放射，呕吐物为胃内容物。对明确诊断最有意义的实验室检查是
A. 尿淀粉酶
B. 血淀粉酶
C. 血白细胞计数
D. 血胆红素
E. 尿常规

正确答案：B。血淀粉酶

解析：中年女性患者，进大量肉食后上腹痛伴呕吐，腹痛为持续性，阵发加重，向左腰背部放射，呕吐物为胃内容物（进食肉食常是急性胰腺炎发病的诱因，持续上腹痛并向左腰背部放射伴呕吐为急性胰腺炎的典型症状）。综合患者的病史、症状，可初步诊断为急性胰腺炎。血、尿淀粉酶测定是诊断急性胰腺炎最有价值的指标，超过正常值3倍即可诊断急性胰腺炎。血淀粉酶（B对）于起病后2～12小时开始升高，尿淀粉酶（A错）于起病后24小时开始升高。患者病程仅6小时，对明确诊断最意义的实验室检查是血淀粉酶（B对）测定。血白细胞计数（C错）、血胆红素（D错）、尿常规（E错）在急性胰腺炎时都可有改变，但缺乏特异性。